《“十三五”国家药品安全规划》确定到2020年完整执业药师制度工作的目标和任务包括
A. 健全执业药师制度体系，强化继续教育与实训培养
B. 所有零售药店营业时有执业药师指导合理用药
C. 所有零售药店主要管理者具备执业药师资格
D. 实施执业药师国际资格互认，完善国际执业药师交流

正确答案：B、C。所有零售药店营业时有执业药师指导合理用药；所有零售药店主要管理者具备执业药师资格

解析：本题考查的是《“十三五”国家药品安全规划》。《“十三五”国家药品安全规划》确定到2020年完整执业药师制度工作的目标和任务包括所有零售药店营业时有执业药师指导合理用药（B对）与所有零售药店主要管理者具备执业药师资格（C对）。2017年2月14日，国务院发布《“十三五”国家药品安全规划》（国发〔2017〕12号），确定执业药师服务水平显著提高的发展目标，要求到2020年，每万人口执业药师数超过4人，所有零售药店主要管理者具备执业药师资格、营业时有执业药师指导合理用药。